静脉导管闭锁的遗迹是
A. 肝圆韧带
B. 静脉韧带
C. 第2肝门
D. 肝总管
E. 胆总管

正确答案：B。静脉韧带

解析：静脉韧带(B对)为胎儿时期静脉导管闭锁的遗迹，肝圆韧带(A错)为脐静脉闭锁的遗迹。